下列属于细胞凋亡检测的是
A. MTT比色法
B. 细胞病变抑制法
C. 细胞增殖法
D. 琼脂糖凝胶电泳法
E. 以上均正确

正确答案：D。琼脂糖凝胶电泳法

解析：细胞凋亡检测：琼脂糖凝胶电泳法、FACS法、TUNEL法。掌握“免疫学检测技术”知识点。